关于注射剂的有关规定的说法，错误的是
A. 除另有规定外，注射剂容器应足够透明，以便内容物的检视
B. 混悬性注射剂允许有可见沉淀，但振摇时应容易分散均匀
C. 乳状液型注射剂允许出现相分离，但振摇时应分散均匀
D. 注射用无菌粉末的标签或说明书应标明其中所用辅料的名称
E. 注射剂所用辅料中若有抑菌剂，在标签或说明书上应标明抑菌剂的种类和浓度

正确答案：C。乳状液型注射剂允许出现相分离，但振摇时应分散均匀

解析：本题考查的是注射剂的质量要求。乳液型注射剂不得有相分离现象（C错，为本题正确答案）。溶液型注射剂应澄清。除另有规定外，混悬型注射液中原料药物粒径应控制在15μm以下，含15～20μm（间有个别20～50μm）者，不应超过10%，若有可见沉淀，振摇时应容易分散均匀（B对）。混悬型注射液不得用于静脉注射或椎管内注射；乳状液型注射液不得有相分离现象，不得用于椎管内注射。静脉用乳状液型注射液中90%的乳滴粒径应在1μm以下，不得有大于5μm的乳滴。除另有归定外，输液应尽可能与血液等渗。注射剂常用容器有玻璃安瓿、玻璃瓶、塑料安瓿、塑料瓶（袋）、预装式注射器等。除另有规定外，容器应足够透明，以便内容物的检视（A对）。注射剂的标签或说明书中应标明其中所用辅料的名称（D对），如有抑菌剂还应标明抑菌剂的种类及浓度（E对）；注射用无菌粉末应标明配制溶液所用的溶剂的种类，必要时还应标注溶剂量。